味苦，性温，既理气宽中，又燥湿，消食的药是
A. 香橼
B. 甘松
C. 化橘红
D. 橘红
E. 枳壳

正确答案：C。化橘红

解析：本题考查的是化橘红的性味归经与功效。味苦，性温，既理气宽中，又燥湿，消食的药是化橘红（C对）。化橘红：【性味归经】辛、苦，温。归肺、脾、胃经。【功效】理气宽中，燥湿化痰，消食。香橼（A错）：【性味归经】辛、苦、酸，温。归肝、脾、肺经。【功效】疏肝理气，和中化痰。甘松（B错）：【性味归经】辛、甘，温。归脾、胃经。【功效】行气止痛，开郁醒脾。橘红（D错）：【性味归经】辛、苦，温。归肺、脾经。【功效】行气宽中，燥湿化痰，发表散寒。枳壳（E错）：【性味归经】苦、辛，微寒。归脾、胃、大肠经。【功效】理气宽中，行滞消胀。